选择100例肺癌患者和200例对照进行吸烟与肺癌关系的病例对照研究，调查发现100例患者中有50人吸烟，200例对照中也有50人吸烟，则OR值为
A. OR=1
B. OR=2
C. OR=3
D. OR=5
E. OR=6

正确答案：C。OR=3